全口义齿的固位是指
A. 咀嚼时义齿不脱落
B. 大张口时义齿不脱落
C. 说话时义高齿不脱落
D. 抬舌头时义齿不脱落
E. 从口内取下义齿时有阻力

正确答案：E。从口内取下义齿时有阻力

解析：本题考查全口义齿的固位。全口义齿的固位是指义齿抵抗从口内垂直脱位的能力，即在将全口义齿从口内取下时，不能很顺利的摘下，而是存在一定的阻力（E对）。咀嚼时义齿不脱落（A错）代表义齿垂直向颌位关系正确。大张口时义齿不脱落（B错）说明义齿颊侧边缘伸展范围合适，没有影响肌肉的收缩性活动。说话时义齿不脱落（C错）说明义齿边缘不影响系带的功能活动。抬舌头时义齿不脱落（D错）说明下颌义齿舌侧边缘不影响舌系带的功能活动。